一正常小儿身高90cm，前囟门已闭，头围48.5cm，乳牙20枚，血压是86/55mmHg。此小儿的年龄最大的可能是
A. 1岁半
B. 2岁
C. 3岁
D. 4岁
E. 5岁

正确答案：C。3岁

解析：据此题干提供的数据，身高90cm，根据2～12岁小儿身高的计算公式“年龄（岁）×7+75=身高”，可得出年龄为2岁多，头围48.5c m也推测出年龄为2岁多，但由于2～15岁小儿头围生长缓慢，仅增加6～7cm，所以头围的测量只在2岁以内最有价值。小儿血压计算，收缩压=（年龄×2）+80（mmHg），计算得出3岁。前囟的关闭时间最迟为2岁。但乳牙的萌出最迟于3岁前出齐。综合考虑，此患儿最可能的年龄为3岁（C对）。